我国卫生事业公益性的最高原则是
A. 经济效益
B. 社会效益
C. 经济效益和社会效益
D. 病人利益

正确答案：B。社会效益

解析：本题考查我国卫生事业公益性的最高原则。我国卫生事业公益性的最高原则是社会效益（B对ACDE错）。